为达到良好的抗力形，下列哪条是错误的
A. 去除无基釉质
B. 洞在牙本质有一定的深度，
C. 洞底线角明确
D. 去除薄壁弱尖

正确答案：C。洞底线角明确

解析：本题考查窝洞的抗力形。为达到良好的抗力形错误的是洞底线角明确（C错，为本题的正确答案）。无机釉缺乏牙本质支持，在承受咬合力时容易折裂，为达到良好的抗力形，应去除无基釉质（A对）。洞在牙本质内有一定的深度（B对），有助于增加充填体抗力。洞底线角明确会导致应力集中，在承受咬合力时，充填体和牙体组织易折裂，为避免应力集中洞底线角应圆钝。去除薄壁弱尖，可避免牙体组织在承受咬合力时发生折裂（D对）。